下列吸水性最好的软膏基质是
A. 石蜡
B. 植物油
C. 蜂蜡
D. 凡士林
E. 羊毛脂

正确答案：E。羊毛脂

解析：本题考查的是软膏剂、乳膏剂的油脂性基质。下列吸水性最好的软膏基质是羊毛脂（E对）。软膏剂、乳膏剂的油脂性基质：油脂性基质主要包括油脂类、类脂类、烃类和硅酮类。（1）油脂类：系从动物或植物中获得的高级脂肪酸甘油酯及其混合物。因含有不饱和双键，易氧化酸败，可加入抗氧化剂和防腐剂改善。常用的有动、植物油，氢化植物油等。植物油（B错）常与熔点较高的蜡类熔合制成稠度适宜的基质，如中药油膏常用麻油与蜂蜡熔合为基质。（2）类脂类：系高级脂肪酸与高级脂肪醇形成的酯类，其物理性质与油脂类相似。①羊毛脂：又称无水羊毛脂，为淡黄色黏稠半固体，熔点36℃～42℃，因含胆甾醇、异胆甾醇与羟基胆甾醇及其酯而有较大的吸水性，可吸水150%、甘油140%、70%的乙醇40%。由于羊毛脂的组成与皮脂分泌物相近，故可提高软膏中药物的渗透性。常与凡士林合用，调节凡士林的渗透性和吸水性。②蜂蜡（C错）：有黄蜡、白蜡之分。白蜡系由黄蜡漂白精制而成，主要成分为棕榈酸蜂蜡醇酯，熔点为62℃～67℃。常用调节软膏的稠度或增加稳定性。因含有少量的游离高级脂肪醇而有乳化作用，可作辅助乳化剂。此类还有虫白蜡、鲸蜡等，主要用于增加基质的稠度。（3）烃类：系石油分熘得到的多种高级烃的混合物，大部分为饱和烃类。性质稳定，很少与药物发生作用。不易被皮肤吸收，尤适用于保护性软膏。①凡士林（D错）：系液体与固体烃类形成的半固体混合物，有黄、白两种。白凡士林由黄凡士林漂白而得，熔点为38℃～60℃。具有适宜的稠度和涂展性，且对皮肤与黏膜无刺激性。性质稳定，不酸败，可与大多数药物配伍。油腻性大而吸水性较差（仅能吸水5%），故不宜用于有多量渗出液的患处。但与适量的羊毛脂、鲸蜡醇或胆甾醇等合用，可增加其吸水性。加入适量的表面活性剂可改善药物的释放与穿透性。②石蜡（A错）与液态石蜡：石蜡为多种固体烃的混合物，可与脂肪油、蜂蜡等熔合；液体石蜡是多种液体烃的混合物，能与多数脂肪油或挥发油混合。两者主要用于调节软膏稠度，液状石蜡还可用以研磨药物粉末，使易于基质混匀。（4）硅酮类：为有机硅氧化物的聚合物，俗称硅油。常用二甲硅油，为无色澄清的透明油状液体，无臭、无味，黏度随分子量的增加而增大，在-40℃～150℃应用范围内，黏度变化极小，化学性质稳定，无毒性，对皮肤无刺激性，不污染衣物，具有良好的润滑作用，易于涂布，能与羊毛脂、硬脂醇、鲸蜡醇、硬脂酸甘油酯等混合，因此常用于乳膏剂，最大用量可达10%～30%，也可与其他油脂类基质合用制成防护性软膏。本品对眼睛有刺激性，不宜作为眼膏基质。